用普通手术刀手术后的创口首先出现
A. 过敏反应
B. 炎症反应
C. 水肿
D. 肉芽组织
E. 脓液

正确答案：B。炎症反应

解析：用普通手术刀手术后的创口，在其两缘的缝隙间首先出现炎症反应，充以血液和含有纤维蛋白原的渗出液，并迅速凝集成块。掌握“口外创口处理”知识点。